精原细胞发育为精子约需
A. 7天
B. 14天
C. 28天
D. 46天
E. 64天

正确答案：E。64天

解析：精原细胞发育为精子的过程中，各级生精细胞需突破支持细胞之间的连接结构向管腔侧及睾丸输出小管方向迁移，最后将精子释放入曲细精管腔，整个过程约需 64 天（E对）。